空气气流以水平运动为主的是
A. 对流层
B. 平流层
C. 中间层
D. 热成层
E. 逸散层

正确答案：B。平流层

解析：本题考查大气层。平流层（B对ACDE错）位于对流层之上，其特点是空气气流以水平运动为主。